膀胱结石患者典型的排尿症状是
A. 排尿疼痛
B. 尿频、尿急、尿痛
C. 血尿
D. 排尿突然中断
E. 排尿困难

正确答案：D。排尿突然中断

解析：膀胱结石的典型症状为排尿突然中断（D对）；排尿疼痛（A错）多见于尿路感染。尿频、尿急、尿痛（B错）属于膀胱刺激征，多见于尿路感染及肾结核。血尿（C错）伴疼痛多见于尿路结石；无痛性血尿多应考虑泌尿系肿瘤。排尿困难（E错）多见于尿路梗阻及前列腺增生。